病人左侧瞳孔移向下外可能是何神经受损所致
A. 左动眼神经
B. 左滑车神经
C. 左展神经
D. 右动眼神经
E. 无

正确答案：A。左动眼神经

解析：左动眼神经（A对）支配左侧上直肌等眼内肌，损伤后导致左侧瞳孔移向下外。滑车神经（B错）支配上斜肌，损伤后导致瞳孔移上外内。展神经（C错）支配外直肌，损伤后产生内斜视。